不是细菌侵袭性酶的是
A. 血浆凝固酶
B. 透明质酸酶
C. 链激酶
D. 溶菌酶
E. 以上均不正确

正确答案：D。溶菌酶

解析：细菌侵袭性酶是指许多在组织中繁殖起来的细菌释放的侵袭性胞外酶，有利于病原菌的抗吞噬作用并向周围组织扩散，如致病性葡萄球菌产生的凝固酶（血浆凝固酶）（A对）、A群链球菌产生的透明质酸（B对）、链激酶（C对）、链道酶等。溶菌酶（D错，为本题正确答案）能破坏细菌细胞壁的肽聚糖骨架，引起细菌裂解，是细菌L型最常用的人工诱导剂，不属于细菌侵袭性酶。